Ⅲ度营养不良患儿的饮食治疗，最初应供给热卡（按理想体重计）
A. 0.17MJ/（kg·d）
B. 0.085MJ/（kg·d）
C. 0.25MJ/（kg·d）
D. 0.34MJ/（kg·d）
E. 0.46MJ/（kg·d）

正确答案：A。0.17MJ/（kg·d）

解析：本题考查Ⅲ度营养不良患儿的饮食治疗。Ⅲ度营养不良患儿因消化功能与对食物耐受力均差，常并发消化道功能紊乱，因此在原有膳食基础上从小量开始，逐步调整饮食。Ⅲ度营养不良患儿的饮食治疗，最初应供给热卡（按理想体重计）0.17MJ/（kg·d）（A对BCDE错）。